按照抗菌药物PK/PD理论，下列给药方案中，错误的是
A. 注射用青霉素钠480万单位，iv，q8h
B. 莫西沙星0.4g，po，bid
C. 注射用美罗培南1g，iv，q8h
D. 阿奇霉素片0.5g，po，qd
E. 注射用头孢曲松钠1g，iv，qd

正确答案：B。莫西沙星0.4g，po，bid

解析：本题考查抗菌药物的使用。按照抗菌药物PK/PD理论，下列给药方案中，错误的是：莫西沙星0.4g，po，bid（B错，为本题正确答案）。莫西沙星用药方式：（1）口服：成人一次400mg，一日1次，慢性气管炎急性发作连续应用5日，社区获得性肺炎10日，急性鼻窦炎连续7日，皮肤和软组织感染连续7日。（2）静脉滴注：一次0.4g，一日1次，滴注90min。给药方案正确的有：注射用青霉素钠480万单位，iv，q8h（A对）；注射用美罗培南1g，iv，q8h（C对）；阿奇霉素片0.5g，po，qd（D对）；注射用头孢曲松钠1g，iv，qd（E对）。